胃的特性之一是
A. 喜润恶燥主升
B. 喜润恶燥主降
C. 喜燥恶湿主升
D. 喜燥恶湿主降
E. 以上都不是

正确答案：B。喜润恶燥主降

解析：胃气主降，脾气主升，二者相反相成；脾气升则水谷精微得以输布，胃气降则食糜糟粕得以下传。胃喜润恶燥，是胃当保持充足的津液以利饮食物的受纳腐熟。胃的受纳腐熟，不仅依赖胃气推动和蒸化，亦需胃中津液的濡润。胃中津液充足，则能维持其受纳腐熟的功能和通降下行的特性（B对）。脾喜燥恶湿主升（ACDE错）。